男，49岁。既往体健，因头晕半天，黑便3次，急诊。血压80/50mmHg，心率124次/分，面色苍白，冷汗。最能尽快明确诊断的检查是
A. 超声心动图
B. CT
C. 血生化、心肌酶
D. 胸片
E. 胃镜

正确答案：E。胃镜

解析：中年男性患者，既往体健，头晕半天，黑便3次，血压下降、脉快，面色苍白，冷汗，提示上消化道出血。待病情稳定后，最能尽快明确诊断的检查是胃镜（E对），因其不仅可以明确出血的部位和性质，同时还可以进行止血。超声心动图（A错）主要用于心脏和大血管病变的诊断，而对上消化道出血的诊断价值不大。CT（B错）有助于发现肝、胆和胰腺结石、肿瘤等病变或鉴别诊断，而对于诊断上消化道出血意义不大。血生化、心肌酶（C错）可用于诊断心肌梗死等疾病，对于诊断上消化道出血意义不大。胸片（D错）主要用于肺部病变的诊断。